男，45岁。左颈部淋巴结进行性肿大3个月。淋巴结活检病理结果示弥漫性大B细胞淋巴瘤。最可能出现的细胞免疫表型是
A. CD10⁺
B. CD13⁺
C. CD20⁺
D. CD5⁺
E. CD34⁺

正确答案：C。CD20⁺

解析：患者淋巴结结活检病理结果示弥漫性大B细胞淋巴瘤，最可能出现的细胞免疫表型是B细胞分化抗原CD19、CD20（C对）和CD79a。CD10+（A错）为滤泡生发中心的免疫标记，弥漫性大B细胞淋巴瘤也可为阳性，但不是最佳答案。CD13+（B错）是髓样肿瘤的免疫标记，CD5+（D错）是T细胞肿瘤的免疫标记，CD34+（E错）是多潜能干细胞的免疫标记。